甲亢心脏病最常见的心律失常
A. 窦性心动过缓
B. 室性早搏
C. 房室传导阻滞
D. 体位性低血压
E. 房颤

正确答案：E。房颤

解析：甲亢对心脏有3个作用：①增强心脏β受体对儿茶酚胺的敏感性；②直接作用于心肌收缩蛋白，增强心肌的正性肌力作用；③继发于甲状腺激素导致的外周血管扩张，阻力下降，心脏搏出量代偿性增加。上述作用导致心动过速、心脏排出量增加、心房颤动和心力衰竭。甲亢心脏病心律失常多是室上性的（B错），最常见的心律失常为房颤（E对）。窦性心率过缓（A错）可见于甲状腺功能减退。